男婴，1个月，腹胀，便秘1个月，查体腹部明显隆起，腹壁静脉显露明显，肠鸣音较活跃，肛门指检时排出恶臭气体及大便，腹部立位X线平片可多个阶梯状液平。首先考虑的诊断是
A. 坏死性小肠结肠炎
B. 先天性巨结肠
C. 功能性便秘
D. 先天性肠旋转不良
E. 胎粪塞综合征

正确答案：B。先天性巨结肠

解析：患儿月龄1月，自出生即有腹胀，便秘等临床表现（提示先天性肠道畸形）。查体：腹壁静脉显露明显（系肠梗阻腹压高压迫阻碍静脉回流所致），肠鸣音较活跃，肛门指检时排出恶臭气体及大便。X片显示：腹部立位多个阶梯状液平（提示低位肠梗阻），结合患者年龄，临床表现、体征及影像学检查，首先考虑的诊断是先天性巨结肠（B对）。坏死性小肠结肠炎（A错）与先天性巨结肠伴发小肠结肠炎很难鉴别 。本病多为早产儿，围生期多有窒息、缺氧、感染、休克的病史，且有便血。X 线平片示肠壁有气囊肿和（或）门静脉积气。功能性便秘（C错）多见于婴儿及儿童期，无器质性病变，主要表现为排便次数少、排便费力、粪质较硬或呈球状等症状。先天性肠旋转不良（D错）临床表现主要为阵发性腹痛和频繁呕吐，扭转不能自动回复者可引发较窄型肠坏死，患儿全腹膨隆，压痛明显，腹肌紧张，血便，严重者中毒、休克。胎粪塞综合征（E错）表现为一过性低位肠梗阻症状，经灌肠排出胎粪后，即可正常排便且不再复发。